腹腔神经节的性质
A. 交感神经节
B. 副交感神经节
C. 椎旁神经节
D. 器官旁节
E. 内脏感觉神经节

正确答案：A。交感神经节

解析：交感神经按其所在的位置可分为椎前神经节和椎旁神经节，椎前神经节包括腹腔神经节,肠系膜上神经节，肠系膜下神经节及主动脉肾神经节等，所以腹腔神经节的性质为交感神经节（A对）。